有关影响分布的因素错误的是
A. 脂溶性高的药物的分布范围较广
B. 小分子药物的分布范围较广
C. 碱化尿液可增加酸性药物的排泄
D. 只有脂溶性高的药物可以通过血脑屏障
E. 血浆蛋白结合率高的药物可以通过血脑屏障

正确答案：E。血浆蛋白结合率高的药物可以通过血脑屏障

解析：大多数药物与血浆蛋白均有不同程度的结合而形成结合型药物，结合型药物不能跨膜运输，不能通过血脑屏障（E错，为本题正确答案），成为药物在血液中的一种暂时贮存形式，血浆中游离型药物随分布、代谢减少时，结合型药物可释放出游离药物。药物在体内的分布受很多因素的影响，包括药物的脂溶度、毛细血管通透性、器官和阻止血流量、与血浆蛋白的结合能力等，其中脂溶性高的药物易吸收，易通过细胞膜的体内屏障，分布范围广（A对）。小分子药物易吸收，体内分布范围较广（B对）。碱化尿液可减少酸性药物在肾小管的重吸收，促使药物从尿中排出，增加酸性药物排泄（C对）。血脑屏障是指血管壁与神经胶质细胞形成的血浆与细胞外液间的屏障和由脉络丛形成的血浆与脑脊液间的屏障，对药物通过有重要屏蔽作用，能够阻止许多大分子、水溶性或解离型药物进入脑组织，但脂溶性较高的药物仍能以简单扩散的方式穿过血脑屏障（D对）。